以非均匀分散体系构成的剂型包括
A. 溶液型
B. 高分子溶液型
C. 乳浊型
D. 混悬型
E. 固体分散型

正确答案：C、D。乳浊型；混悬型

解析：本题考查非均相液体制剂。乳浊型（C对）和混悬型（D对）是非均匀分散体系，两者的动力学和热力学均不稳定。溶液型（A错）、高分子溶液（B错）是真溶液，为均匀分散系统；固体分散（E错）型中，有些药物在载体中呈分子状态分散，是均相体系。